属于既往史的是
A. 月经情况
B. 生育情况
C. 冶游史
D. 家族遗传病史
E. 预防接种史

正确答案：E。预防接种史

解析：属于既往史的是预防接种史，既往史是患者既往的健康情况及患过的疾病、外伤手术、预防接种、对药物及食物的过敏史等（E对）。月经情况属于月经史（A错）。生育情况属于生育史（B错）。冶游史属于个人史（C错）。家族遗传病史属于家族史（D错）。